关于布鲁菌的生物学性状，不正确的是
A. 革兰阴性球杆菌
B. 不形成芽胞
C. 一般无荚膜
D. 有鞭毛
E. 专性需氧

正确答案：D。有鞭毛

解析：布鲁氏菌为小球杆状菌（0.3～0.8）μm×（0.5～1.5）μm，革兰氏染色阴性，无鞭毛，不形成芽胞，一般无荚膜，在光滑型菌可有微荚膜。掌握“动物源性细菌”知识点。